下列各项，口苦的临床意义是
A. 湿热蕴脾
B. 痰热内盛
C. 心血不足
D. 心火上炎
E. 胃火炽盛

正确答案：D。心火上炎

解析：口苦 指病人自觉口中有苦味的症状。多见于心火上炎或肝胆火热之证（D对）。湿热蕴脾，患者会出现口甜的症状（A错）。痰热内盛则出现口黏腻的症状（B错）。心血不足则心悸怔忡，虽静卧不能减轻，头晕目眩，面色无华，唇舌色淡，脉细弱，或结代。一般不会有特殊的口味（C错）。胃火炽盛则口渴，出现口臭（E错）。